在体内有部分药物可代谢产生吗啡，被列入我国麻醉药品品种目录的药物是
A. 盐酸氨溴索
B. 羧甲司坦
C. 右美沙芬
D. 磷酸苯丙哌林
E. 磷酸可待因

正确答案：E。磷酸可待因

解析：本题考查镇咳药可待因。磷酸可待因（E对）是吗啡的3位甲醚衍生物，在肝脏代谢，代谢后约8%生成吗啡，产生成瘾性，被列入我国麻醉药品品种目录。盐酸氨溴索（A错）是黏痰溶解剂；羧甲司坦（B错）是为半胱氨酸类似物，是一种化痰药物；右美沙芬（C错）基本结构为苯吗喃，可直接抑制延髓咳嗽中枢；磷酸苯丙哌林（D错）用于治疗急、慢性支气管炎及各种刺激引起的咳嗽。以上四种药物均不能代谢产生吗啡。